根据基牙倾斜的方向和程度不同，导线可分三型，正确的是
A. 基牙向缺隙侧倾斜所画出的导线为Ⅰ型导线
B. Ι型导线在基牙近缺隙侧距（牙合）面近
C. 基牙向缺隙相反方向倾斜所画出的导线为Ⅱ型导线
D. Ⅱ型导线在远缺隙侧距（牙合）面远
E. 基牙近远缺隙侧均无明显倒凹或基牙向近远中倾斜时所画的导线为Ⅲ型导线

正确答案：D。Ⅱ型导线在远缺隙侧距（牙合）面远

解析：本题考查观测线与倒凹。根据基牙倾斜的方向和程度不同，导线可分三型，正确的是Ⅱ型导线在远缺隙侧距（牙合）面远（D对）。Ⅱ型导线基牙上主要倒凹区在近缺隙侧，远缺隙侧倒凹较小，导线在远缺隙侧距（牙合）面远。基牙向缺隙侧倾斜所画出的导线为Ⅱ型导线（A错），不是Ⅰ型导线。基牙向缺隙相反方向倾斜所画出的导线为Ⅰ型导线（C错），不是Ⅱ型导线，倒凹越大导线距（牙合）面越近，倒凹越小导线距（牙合）面越远。Ι型导线的主要倒凹区在远缺隙侧，近缺隙侧倒凹较小，导线在基牙近缺隙侧距（牙合）面较远（B错）。基牙的近、远缺隙侧均有明显倒凹或基牙向颊、舌侧倾斜时所形成的导线为Ⅲ型导线（E错）。